治疗盘状红斑狼疮可选用
A. 利巴韦林
B. 羟氯喹
C. 维甲酸
D. 氟康唑
E. 氯苯那敏

正确答案：B。羟氯喹

解析：本题考查治疗盘状红斑狼疮的药物。盘状红斑狼疮是一种结缔组织病，其发病与免疫、紫外线创伤等因素有关。治疗可选用氯喹（B对），氯喹与羟氯喹作用机制相同，主要通过稳定溶酶体膜、抑制免疫等机制，产生抗炎、减少免疫复合物的形成、减轻组织和细胞损伤等作用，还可增强皮肤黏膜对紫外线的耐受力，但毒副作用较羟氯喹大。利巴韦林（A错）是抗病毒药物，可用于治疗单纯疱疹。维甲酸（C错）即维生素A，可用于治疗白斑。氟康唑（D错）是抗真菌药物，可用于治疗念珠菌病。氯苯那敏（E错）是抗组胺药，可用于治疗药物过敏性口炎。这几种药物对于治疗盘状红斑狼疮不起作用。